上颌神经阻滞麻醉二次进针的方向正确的是
A. 向后10°，向下15°
B. 向上10°，向前15°
C. 向下10°，向后15°
D. 向下10°，向前15°
E. 向上10°，向后15°

正确答案：B。向上10°，向前15°

解析：本题考查上颌神经阻滞麻醉口外注射法。上颌神经阻滞麻醉常用的方法有翼腭管注射法和口外注射法，其中口外注射法是避开下颌骨冠突，在其后方从颧弓下方进针直达翼腭窝以麻醉上颌神经的方法，可选用7.5cm长的25号针头，置一消毒橡皮片于距针尖5cm处，作为进针的限制深度。首先标出颧弓与下颌切迹之间的中点作为进针点，注入少量麻药于皮下，再自皮肤垂直进针直抵翼外板；此时，调整橡皮片的位置使之距皮肤约1cm，即欲进针至翼腭窝的深度，一般总深度不超过5cm，然后退针到皮下，针尖重新向上10°，向前15°（B对）进针，直到橡皮片标志处即已到达翼腭窝。由于此处血管丰富，注射麻药前必须回吸无血才能注药。